纵隔偏向健侧的疾病不包括
A. 血胸
B. 开放性气胸
C. 张力性气胸
D. 慢性脓胸
E. 急性脓胸

正确答案：D。慢性脓胸

解析：慢性脓胸（D错，为本题正确答案）由于长期慢性炎症刺激，导致脏、壁层胸膜（即脓腔壁）纤维性增厚，壁胸膜增厚的纤维板使肋骨聚拢，肋间隙变窄，胸廓塌陷，脓腔壁收缩可使纵隔向患侧移位。开放性气胸（B对）和张力性气胸（C对）病人的患侧胸内压高于健侧，可压迫纵隔向健侧偏移；血胸（A对）和急性脓胸（E对）患者短期内均可出现患侧胸膜腔内液体增加，推移纵膈向健侧移位。